常见于乳牙根尖周严重感染，影响继承恒牙釉质发育不全，称为
A. 桑葚牙
B. 牛牙样牙
C. 特纳牙
D. 畸形中央尖
E. 牙内陷

正确答案：C。特纳牙

解析：常见于乳牙根尖周严重感染，影响继承恒牙釉质发育不全。这种情况称为特纳牙。掌握“釉质发育不全”知识点。